男性，25岁，双下肢挤压伤，神志尚清楚，表情淡漠，口渴明显，面色苍白，皮肤湿冷，脉搏112次/分，血压12/9.33kPa（90/70mmHg），中心静脉压0.39kPa（4cmH2O）。毛细血管充盈迟缓。血pH值为7.32。应采取下列哪项措施最为有效
A. 应用收缩血管药物
B. 充分补给液体
C. 纠正酸中毒
D. 给予强心药物
E. 应用扩张血管药物

正确答案：B。充分补给液体

解析：因为循环血量不足造成休克，所以休克的治疗先补足血容量为先。治疗方法应该以充分补液为主。掌握“休克”知识点。